某女，48岁。症见心悸易惊、失眠多梦、健忘。证属心气虚寒，宜选用的中成药是
A. 柏子养心丸
B. 天王补心丸
C. 养血安神丸
D. 枣仁安神颗粒
E. 朱砂安神丸

正确答案：A。柏子养心丸

解析：本题考查柏子养心丸的主治。证属心气虚寒，宜选用的中成药是柏子养心丸（A对）。柏子养心丸【主治】心气虚寒，心悸易惊，失眠多梦，健忘。天王补心丸（B错）【主治】心阴不足，心悸健忘，失眠多梦，大便干燥。养血安神丸（C错）【主治】阴虚血少所致的头眩心悸、失眠健忘。枣仁安神颗粒（D错）【主治】心血不足所致的失眠、健忘、心烦、头晕；神经衰弱症见上述证候者。朱砂安神丸（E错）【主治】心火亢盛、阴血不足证，症见心神烦乱、失眠多梦、心悸不宁、舌尖红、脉细数。